龋病的病源因素为
A. 细菌
B. 易感牙面
C. 食物
D. 一定的时间
E. 以上因素均有

正确答案：A。细菌

解析：本题考查龋病的病源因素。龋病是一种多因素疾病，一般认为是由宿主、微生物、饮食、时间相互作用而成，即四联因素理论。其中龋病的病源因素是细菌（A对）。大量证据证明细菌的存在是龋病发生的先决条件。在龋病的病因学研究中，涉及细菌的证据是确凿的，无菌饲养的动物不会发生龋病，即没有细菌就不会发生龋病。细菌的致龋作用可以概括为细菌代谢碳水化合物产酸，但由于菌斑基质的屏障作用，这些酸不易扩散，因而导致局部pH下降，造成牙体硬组织脱矿，最终形成龋齿。在此过程中，易感牙面（B错）、食物（C错）特别是高糖饮食、一定的时间（D错）都是龋病发病的促进因素，但不是病源因素，因为龋病是一种牙体硬组织进行性脱矿破坏的疾病，而酸蚀造成脱矿的原因，而酸是由细菌代谢产生的，因此只要有细菌的存在，龋病就可能发生，细菌是龋病的病源因素。